下列疾病中引起血清总胆固醇降低的是
A. 脂肪肝
B. 肝炎后肝硬化
C. 胆汁性肝硬化
D. 肾病综合征
E. 甲状腺功能减退症

正确答案：B。肝炎后肝硬化

解析：血清总胆固醇降低见于严重的肝脏疾病，如重症肝炎、肝炎后肝硬化（B对）。胆汁性肝硬化（C错）患者胆汁中胆固醇排出受阻，血清总胆固醇升高。甲状腺功能减退症（P690）（E错）、肾病综合征（P470）（D错）血清总胆固醇偏高。脂肪肝（A错）与血清总胆固醇没有必然联系，与甘油三酯高低有关。